男，56岁。突发呕吐1小时。呕吐约500ml，鲜红色，可见血块，伴大汗、心慌。查体：T38.5℃，P112次／分，R26次／分，BP114/80mmHg。巩膜轻度黄染，肝掌（＋），胸壁可见蜘蛛痣，心肺未见明显异常，腹胀，肝肋下未触及。脾肋下3cm，移动性浊音（＋）。血常规：Hb95g/L，WBC3.6×10⁹/L，Plt46×10⁹/L。半年前上消化道X线钡剂造影示食管虫蚀状改变，可见蚯蚓状及串球状影。如该患者未及时治疗，最易出现的并发症是
A. 急性肾衰
B. 急性肝脓肿
C. 肝性脑病
D. 急性心衰
E. 局限性腹膜炎

正确答案：C。肝性脑病

解析：消化道大量出血后血液在消化道内被分解，大量的血红蛋白被释放，在肠道细菌的分解下产生大量的氨，并在肠道被吸收，同时肝由于肝功能失代偿解毒能力下降，使得血氨浓度上升，通过血脑屏障后进入脑部，通过多方面干扰脑功能：①干扰脑细胞三羧酸循环，脑细胞能量供应不足；②增加脑对酪氨酸、苯丙氨酸、色氨酸等的摄取，它们对脑功能具有抑制作用；③脑内NH₃升高，增加谷氨酰胺合成，神经元细胞肿胀，导致脑水肿；④NH₃ 直接干扰脑神经电活动；⑤弥散入大脑的NH₃可上调脑星形胶质细胞苯二氮䓬受体表达，促使氯离子内流，神经传导被抑制，而导致肝性脑病。